口腔颌面部损伤伴发的颅脑损伤不包括
A. 脑震荡
B. 脑挫裂伤
C. 上颌窦穿孔
D. 颅骨骨折
E. 脑脊液漏

正确答案：C。上颌窦穿孔

解析：由于口腔颌面部邻近颅脑，颌面伤常伴发颅脑损伤，发生率约为40%。颅脑损伤包括脑震荡、脑挫裂伤、颅内血肿、颅骨骨折和脑脊液漏等。掌握“口腔颌面部创伤急救”知识点。